儿童弱视的高危人群为
A. 新生儿
B. 婴幼儿
C. 学龄前儿童
D. 小学生
E. 中学生

正确答案：B。婴幼儿

解析：本题考查儿童弱视的高危人群。3岁以内为儿童视觉发育的关键期，故婴幼儿（B对ACDE错）为弱视的高危人群。